60岁女性患者，2个半月前有车祸头受伤史，当时有一过性意识障碍，伤后头痛，逐渐好转，近半个月又出现头痛，越来越重，头颅CT示右额颞顶低密度新月状影像，脑室中线受压移位，术后哪项处理是错误的
A. 0.4g止血芳酸静点
B. 20%甘露醇250ml静点
C. 给予抗生素预防感染
D. 支持疗法
E. 头痛可给予镇痛药物

正确答案：B。20%甘露醇250ml静点

解析：老年女性患者，2个半月前头部外伤史，当时有一过性意识障碍，伤后头痛，好转后疼痛再次加重（颅内压增高的表现），头颅CT示右额颞顶低密度新月状影像（慢性硬膜下血肿的典型影像学表现），结合患者病史、临床表现和影像学检查，应诊断为右额颞顶慢性硬膜下血肿。患者术后颅内高压症状基本缓解，不宜行20%甘露醇静滴（B错，为本题正确答案），否则将进一步降低颅内压，诱发颅内出血。0.4g止血芳酸静滴（A对）防治术后出血、给予抗生素预防术后感染（C对）、镇痛药物治疗术后头痛（E对）、支持疗法（D对），包括补充必要的能量、氨基酸等，均可作为术后常规处理。